舍格伦综合征进行病理检查最常见的取材部位是
A. 颊腺
B. 舌腺
C. 腮腺
D. 唇腺
E. 磨牙后腺

正确答案：D。唇腺

解析：小唇腺是唾液分泌性IgA的主要来源，其浓度比腮腺高4倍。此外，唇腺活检也被认为是诊断舍格伦综合征的一种简便方法。掌握“唾液腺组织学特点”知识点。